在五行学说中，不属肾病诊断依据的是
A. 面色黑
B. 善恐
C. 易骨折
D. 流涎
E. 耳聋

正确答案：D。流涎

解析：肾在体合骨，生髓，其华在发，在窍为耳及二阴，在志为恐，在液为唾，在色为黑，所以表现出来的症状包括面色黑（A对），善恐（B对），易骨折（C对），耳聋（E对）。脾在液为涎，所以脾病才会出现流涎的症状（D错，为本题正确答案）。